流行性出血热可出现的症状是
A. 黏液脓血便
B. 米泔水样便
C. 酒醉貌
D. 皮肤巩膜黄染
E. 皮肤黏膜出血点

正确答案：E。皮肤黏膜出血点

解析：流行性血热可出现的症状是皮肤黏膜出血点（E对），重者可呈酒醉貌（故本题C也对）。黏液脓血便常见于细菌性痢疾等（A错）。米泔水样便常见于重症霍乱、副霍乱等（B错）。皮肤巩膜黄染见于肝功能不全者（D错）。